依照《麻醉药品和精神药品管理条例》的规定，麻醉药品专用账册的保存期限自药品有效期期满之日起不少于
A. 一年
B. 二年
C. 三年
D. 四年
E. 五年

正确答案：E。五年

解析：本题考查麻醉药品与第一类精神药品的储存。依照《麻醉药品和精神药品管理条例》的规定，麻醉药品专用账册的保存期限自药品有效期期满之日起不少于五年（E对）。定点生产企业、全国性批发企业和区域性批发企业、麻醉药品和第一类精神药品的使用单位，应当配备专人负责管理工作，并建立储存麻醉药品和第一类精神药品的专用账册。专用账册的保存期限应当自药品有效期期满之日起不少于5年。